不属于隐形唇裂表现的是
A. 唇峰分离
B. 黏膜亦出现裂隙
C. 皮肤完好无裂开
D. 裂侧皮肤浅沟状凹陷
E. 皮肤下方的肌层未能联合

正确答案：B。黏膜亦出现裂隙

解析：本题考查隐形唇裂的表现。隐形唇裂的黏膜属于表层组织，皮肤黏膜完整，不会出现裂隙，裂隙多出现在显性唇裂中（B错，为本题的本正确答案）。隐形唇裂表现为唇部皮肤和黏膜完整（C对），皮下组织或肌肉裂开（E对），皮肤表面上为浅沟凹陷（D对）。有一道沟或瘢痕超出了上唇的垂直距离，红唇有一切迹，白唇有缺陷，出现不同程度的上唇垂直距离缩短，唇峰分离（A对）。